病人口淡乏味，常提示的是
A. 痰热内盛
B. 湿热蕴脾
C. 肝胃郁热
D. 脾胃虚弱
E. 食滞胃脘

正确答案：D。脾胃虚弱

解析：痰热内盛，痰热上蒸于口，导致口中黏腻（A错）。湿热蕴脾，与谷气相搏，上蒸于口，导致口甜而黏腻不爽（B错）。肝胃郁热，酸入肝，肝郁化热犯胃，胃失合降，导致泛吐酸水（C错）。脾胃虚弱，运化腐熟功能低下，导致口淡乏味（D对）。食滞胃脘，化腐生酸，浊气上泛，导致口中泛酸，气味酸腐（E错）。